能够抑制分枝菌酸用于结核病治疗的药物有
A. 利福平
B. 链霉素
C. 氨苯砜
D. 乙胺丁醇
E. 异烟肼

正确答案：A、B、D、E。利福平；链霉素；乙胺丁醇；异烟肼

解析：本题考查抗结核药。能够抑制分枝杆菌用于结核病治疗的药物有利福平（A对）、链霉素（B对）、乙胺丁醇（D对）、异烟肼（E对）。利福平为利福霉素的人工半合成衍生物，对结核杆菌和麻风杆菌作用强，对繁殖期和静止期的结核杆菌均有效，低浓度时抑菌，高浓度时杀菌。链霉素跨膜能力差，不易透过细胞膜，故主要对细胞外结核分枝杆菌有效，结核分枝杆菌对本品易产生耐药性，长期应用耳毒性增强。乙胺丁醇对繁殖期结核杆菌和其它分枝杆菌有较强抑制作用，对其它微生物几乎无作用，仅对生长繁殖期细菌有效。异烟肼为前药，可被分枝杆菌过氧化氢酶激活，将异烟肼转化为具有酰化能力的活性物质，在结核分枝杆菌的酶系统发挥作用。异烟肼可选择性作用于结核分枝杆菌，对静止期结核杆菌有抑制作用，对繁殖期结核杆菌有杀灭作用。氨苯砜（C错）为砜类抑菌剂，对麻风杆菌有较强的抑菌作用，大剂量时显示杀菌作用，作用于细菌二氢叶酸合成酶，干扰叶酸合成。